属于GLP-1受体激动剂的是
A. 阿卡波糖
B. 二甲双胍
C. 那格列奈
D. 艾塞那肽
E. 吡格列酮

正确答案：D。艾塞那肽

解析：本题考查GLP-1受体激动剂。艾塞那肽（D对）属于GLP-1受体激动剂。口服降糖药的分类：（1）磺酰脲类促胰岛素分泌药：格列齐特、格列喹酮、格列美脲。（2）非磺酰脲类促胰岛分泌药：那格列奈。（3）双胍类药：二甲双胍。（4）α-葡萄糖苷酶抑制剂：阿卡波糖。（5）胰岛素增敏剂：吡格列酮。（6）胰高糖素样肽-1（GLP-1）受体激动剂：代表药为艾塞那肽。（7）二肽基肽酶-4（DPP-4）抑制剂：阿格列汀。